属于高渗性缺水的病因的是
A. 胃肠道消化液持续丢失
B. 大创面慢性渗液
C. 利尿剂
D. 补充水分过多
E. 烧伤暴露疗法

正确答案：E。烧伤暴露疗法

解析：本题考查高渗性缺水的病因。属于高渗性缺水的病因的是烧伤暴露疗法（E对）。高渗性脱水的病因：①摄入水分不足，临床上多见于进食和饮水困难等情况如食管癌致吞咽困难、重危病人给水不足。②水丧失过多，如高热、大量出汗、甲状腺功能亢进及大面积烧伤，均可通过皮肤丢失大量低渗液体。③呕吐、腹泻及消化道引流等可导致等渗或含钠低的消化液丟失。④中枢性或肾性尿崩症时均可经肾排出大量低渗性尿液，使用大量脱水剂如甘露醇、葡萄糖等高渗溶液，以及昏迷病人鼻饲浓缩的高蛋白饮食，均可因为溶质性利尿而导致失水。⑤任何原因引起的过度通气，可经呼吸道黏膜不显性蒸发加强，丢失不含电解质的水分。胃肠道消化液持续丢失（A错）；大创面慢性渗液（B错）；利尿剂（C错）；补充水分过多（D错）均不是高渗性缺水的病因。